复合树脂充填时窝洞消毒剂除下列之一外均禁用
A. 50%麝香草酚
B. 樟脑酚
C. 丁香油
D. 木榴油
E. 75%乙醇

正确答案：E。75%乙醇

解析：本题考查常用的消毒剂。75%乙醇消毒窝洞后酒精会挥发，不会影响树脂的聚合，因此选用复合树脂充填窝洞时可用来消毒窝洞（E对）。丁香酚是一种自由基聚合阻聚剂，在复合树脂充填物下用含丁香酚的水门汀衬层或垫底时，将影响复合树脂的固化。50%麝香草酚（A错）、樟脑酚（B错）、丁香油（C错）、木榴油（D错）均属酚类制剂，会影响复合树脂固化。